骨移植取肋骨时，通常选取的是
A. 2～4肋
B. 5～6肋
C. 5～7肋
D. 6～8肋
E. 7～9肋

正确答案：E。7～9肋

解析：骨移植时一般以自体骨移植为主。骨骼可取肋骨、髂骨。取肋骨时，多在第7～9肋处切取。选择髂骨片移植时一般采用同侧的髂嵴，因其形状、弧度均与缺损部位大体相似。掌握“骨移植”知识点。